下列关于葡萄球菌的相关叙述中，不正确的说法是
A. 无鞭毛和荚膜
B. 可形成芽胞
C. 金葡菌为凝固酶阳性菌，多为致病菌
D. 表皮及腐生葡萄球菌为凝固酶阴性菌
E. 表皮及腐生葡萄球菌多为非致病菌或机会性致病菌

正确答案：B。可形成芽胞

解析：葡萄球菌无鞭毛和荚膜，不形成芽胞。金葡菌为凝固酶阳性菌，多为致病菌，而表皮及腐生葡萄球菌为凝固酶阴性菌，多为非致病菌或机会性致病菌。掌握“葡萄球菌属”知识点。